土茯苓的功效是
A. 健脾安神
B. 通利关节
C. 解毒除湿
D. 活血散结
E. 消肿生肌

正确答案：B、C。通利关节；解毒除湿

解析：本题考查的是土茯苓的功效。土茯苓的功效是通利关节（B对）与解毒除湿（C对）。土茯苓：【功效】解毒，利湿，通利关节。茯苓：【功效】利水渗湿，健脾，安神（A错）。海马：【功效】补肾助阳，活血散结（D错），消肿止痛。乳香：【功效】活血止痛，消肿生肌（E错）。